气胸作胸腔穿刺排气其穿刺点应该在
A. 锁骨中线第2肋间
B. 锁骨中线第3肋间
C. 腋中线第7肋间
D. 腋后线第7肋间
E. 腋后线第8肋间

正确答案：A。锁骨中线第2肋间

解析：气胸作胸腔穿刺排气其穿刺点应该在锁骨中线第2肋间（A对）。